最不密合的边缘是什么
A. 浅凹
B. 深凹
C. 带斜面的直角
D. 肩台
E. 刃状

正确答案：D。肩台

解析：本题考查修复体龈边缘设计应合乎牙周组织健康的要求。最不密合的是肩台边缘（D对）。肩台边缘：一般为90°直角肩台，宽1mm，边缘位置明确；磨牙多，边缘强度好。